下列有关牙髓坏死说法中，错误的是
A. 无自觉症状
B. 牙冠变色、无光泽
C. 开放髓腔时可有恶臭
D. 牙龈有根尖来源的瘘管
E. X线片示根尖周影像无明显异常

正确答案：D。牙龈有根尖来源的瘘管

解析：牙髓坏死：①无自觉症状。可有自发痛史、外伤史、正畸史或充填、修复史等。②牙冠可存在深龋洞或其他牙体硬组织疾病，或是有充填物、深牙周袋等；也可见有完整牙冠者。牙冠变色、无光泽。探深龋洞的穿髓孔无反应，开放髓腔时可有恶臭。③牙髓诊断性试验（温度测验和电测验）无反应：叩诊同正常对照牙或不适；牙龈无根尖来源的瘘管。④X线片示根尖周影像无明显异常。掌握“牙髓坏死、牙髓钙化与牙内吸收”知识点。